有机氟类杀鼠剂的特效解毒剂是
A. 阿托品
B. 解磷定
C. 双复磷
D. 乙酰胺
E. 维生素K₁

正确答案：D。乙酰胺